主要用于控制疟疾复发和传播的药物是
A. 青蒿素
B. 氯喹
C. 奎宁
D. 伯氨喹
E. 乙胺嘧啶

正确答案：D。伯氨喹